枇杷叶的原植物属于
A. 豆科
B. 水龙骨科
C. 柏科
D. 蔷薇科
E. 木兰科

正确答案：D。蔷薇科

解析：本题考查的是枇杷叶的来源。枇杷叶的原植物属于蔷薇科（D对）。枇杷叶：【来源】为蔷薇科植物枇杷的干燥叶。来源于豆科（A错）的中药有葛根、甘草、黄芪、鸡血藤、降香、合欢皮、番泻叶、槐花等。来源于水龙骨科（B错）的中药有骨碎补等。来源于柏科（C错）的中药有侧柏叶等。来源于木兰科（E错）的中药有厚朴、辛夷、五味子、南五味子等。